嗜盐杆菌属于嗜盐球菌属，多见于
A. 水产品
B. 乳制品
C. 冷冻食品
D. 肉、鱼和罐头
E. 咸鱼

正确答案：E。咸鱼